选择性偏倚
A. 由于回忆不准确引起的偏倚
B. 由于对病例的诊断错误所引起的偏倚
C. 两者均是
D. 两者均否

正确答案：D。两者均否

解析：本题考查错分偏倚和回忆偏倚的概念。错分偏倚又称信息偏倚，是指在获取暴露、结局或其他信息时所出现的系统误差或偏差，如判断有病为无病。回忆偏倚是由于研究对象对暴露史或既往史回忆的准确性和完整性存在系统误差而引起的偏倚。两者均不是（D对ABC错）选择性偏倚。